注射吸收差，只适用于诊断与过敏试验的是
A. 静脉注射
B. 皮下注射
C. 皮内注射
D. 鞘内注射
E. 腹腔注射

正确答案：C。皮内注射

解析：本题考查注射给药的给药部位和吸收途径。皮内注射（C对）是将药物注射到真皮中，此部位吸收差，只用于诊断与过敏试验；静脉注射（A错）药物直接进入血液，起效快；皮下注射（B错）的吸收较慢，需延长作用时间的药物可采用皮下注射；鞘内注射（D错）是将药物通过腰穿的方式,直接注入椎管中,通过脑积液循环发挥作用；腹腔注射（E错）即将药物注射到胃肠道浆膜以外，注射后药物经门静脉进入肝脏，影响药物的生物利用度。